混悬剂质量评价不包括的项目是
A. 溶解度的测定
B. 微粒大小的测定
C. 沉降容积比的测定
D. 絮凝度的测定
E. 重新分散试验

正确答案：A。溶解度的测定

解析：本题考查混悬剂。混悬剂的质量评定并不包括溶解的的测定（A错，为本题正确答案）。混悬剂的质量评定：流变学测定和微粒大小的测定（B对）、沉降容积比的测定（C对）、絮凝度的测定（D对）和重新分散试验（E对）。